阿司匹林需要检查的特殊杂质是
A. 游离水杨酸
B. 酮体
C. 游离肼
D. 光降解产物
E. 二苯酮衍生物

正确答案：A。游离水杨酸

解析：本题考查阿司匹林的特殊杂质检查。阿司匹林需要检查的特殊杂质是游离水杨酸（A对）。阿司匹林生产过程中乙酰化不完全或贮藏过程中水解产生游离水杨酸。水杨酸在空气中会逐渐氧化成醌型有色物质（淡黄色、红棕色、深棕色等），使阿司匹林变色，故需检查。酮体（B错）是肾上腺素中需要检查的特殊杂质。游离肼（C错）是异烟肼中需要检查的特殊杂质。光降解产物（D错）是硝苯地平中需要检查的特殊杂质。二苯酮衍生物（E错）是地西泮中需要检查的特殊杂质。